男性，52岁。1个月前发现左下后牙龈有小包，有时口腔内觉有咸水。曾有过左侧后牙夜痛，无其他不适。检查见左下第一前磨牙牙颈部楔状缺损，探硬，轻酸感；左下第二前磨牙牙颈部龋洞深，探无感觉，牙髓无活力，叩诊异常感；左下第一磨牙近中根尖部龈瘘，叩痛（-），牙髓活力正常。主诉牙的诊断最可能是
A. 牙髓坏死
B. 慢性牙髓炎
C. 慢性牙周脓肿
D. 根尖周肉芽肿
E. 慢性牙槽脓肿

正确答案：E。慢性牙槽脓肿

解析：自觉症状：慢性根尖周炎一般无明显的自觉症状，患牙可在咀嚼时有不适感。也有因主诉牙龈起脓疱而就诊者。临床检查①患牙可查及深龋洞或充填体，以及其他牙体硬组织疾病。②牙冠变色，失去光泽。深洞内探诊无反应，牙髓诊断性试验无反应。③患牙对叩诊的反应无明显异常或仅有不适感，一般不松动。④有窦型慢性根尖周炎：患牙根尖部的唇、颊侧或舌、腭侧牙龈表面可查及窦道口，窦道口偶尔可开口远离患根之处。⑤小根尖周囊肿：囊肿在牙龈表面多无异常表现，囊肿发展较大时，可见患牙根尖部的牙龈处呈半球状隆起，不红，双指交替按压扪诊时有乒乓球的弹性手感。囊肿过分增大时，因周围骨质吸收并压迫邻牙，造成邻牙移位或使邻牙牙根吸收。掌握“慢性根尖周炎”知识点。